DNA聚合链中最稳定的碱基对是
A. A-G
B. A-T
C. G-C
D. A-U
E. C-U

正确答案：C。G-C

解析：在DNA双螺旋结构模型的要点中，DNA 的两条多聚脱氧核苷酸链之间形成了互补碱基对，碱基的化学结构特征决定了两条链之间的特有相互作用方式：一条链上的腺嘌呤与另一条链上的胸腺嘧啶形成了两对氢键（B错）；一条链鸟嘌呤与另一条链上的胞嘧啶形成了三对氢键（C对，ADE错）,所以DNA聚合链中最稳定的碱基对是G-C。